在体内发生代谢，生成“亚胺-醌”物质，引发毒性作用的药物是
A. 双氯芬酸
B. 奈法唑酮
C. 普拉洛尔
D. 苯噁洛芬
E. 对乙酰氨基酚

正确答案：A、B、C、E。双氯芬酸；奈法唑酮；普拉洛尔；对乙酰氨基酚

解析：本题考查含有苯胺、苯酚等结构药物的代谢。在体内发生代谢，生成“亚胺-醌”物质，引发毒性作用的药物是双氯芬酸（A对）、奈法唑酮（B对）、普拉洛尔（C对）、对乙酰氨基酚（E对）。双氯芬酸含二苯胺片段，A环胺基的对位没有取代基，故可被CYP3A4或MPO催化代谢氧化，并进一步发生双电子氧化生成亚胺-醌，后者发生亲核取代生成的加成产物会引发肝脏毒性。奈法唑酮含苯基哌嗪片段，可生成4-位羟化代谢物，后者可氧化为亚胺-醌以及N-去芳基化生成氯代对醌，产生肝毒性反应。普拉洛尔在体内的代谢活化首先生成对乙酰氨基酚，继之氧化生成亚胺-醌式结构化合物，该代谢活化产物可与蛋白发生不可逆结合生成产物，后者可导致临床上发生特质性硬化性腹膜炎。苯噁洛芬（D错）代谢产物是葡萄糖醛酸苷酯化合物。